细菌性肝脓肿最主要的原因是
A. 膈下脓肿蔓延
B. 开放性肝脏损伤
C. 化脓性门静脉炎
D. 脓毒症
E. 胆管结石并感染

正确答案：E。胆管结石并感染

解析：细菌性肝脓肿最主要的原因是胆管结石并感染（E对），细菌循胆道上行进入肝脏，引起脓肿。膈下脓肿蔓延（A错）、开放性肝脏损伤（B错）、化脓性门静脉炎（C错）、脓毒症（D错）均可引起细菌性肝脓肿，但不是最主要原因。